引起中药药源性疾病的原因有
A. 正常用法用量服用
B. 超剂量服用
C. 超时间服用
D. 错用
E. 误用

正确答案：A、B、C、D、E。正常用法用量服用；超剂量服用；超时间服用；错用；误用

解析：本题考查的是引起中药药源性疾病的原因。引起中药药源性疾病的原因有正常用法用量服用（A对）、超剂量服用（B对）、超时间服用（C对）、错用（D对）与误用（E对）。引发药物不良反应及药源性疾病的发生：导致药物不良反应的因素很多。有药物的因素，如品种混淆、炮制不当；有患者的因素，如过敏性体质、个体差异、特殊人群；也有辨证是否准确，立法是否确当等。但更不能忽视不合理用药，如选用药物不准确、用药时间过长、剂量过大、用法不适当，均会引起不良反应，甚至药源性疾病。